外源化学物作用于生物体的毒效应谱，随剂量增加表现为
A. 机体负荷增加；意义不明的生理和生化改变；亚临床改变；临床中毒
B. 意义不明的生理和生化改变；机体负荷增加；亚临床改变；临床中毒
C. 机体负荷增加；意义不明的生理和生化改变；临床中毒；亚临床改变
D. 意义不明的生理和生化改变；机体负荷增加；临床中毒；亚临床改变

正确答案：A。机体负荷增加；意义不明的生理和生化改变；亚临床改变；临床中毒

解析：本题考查毒效应谱的相关内容。外源化学物作用于生物体的毒效应谱，随剂量增加表现为：①外源化学物的机体负荷增加；②意义不明的生理和生化改变；③亚临床改变；④临床中毒（A对BCD错）；⑤死亡。